女，59岁。无痛性进行性皮肤巩膜黄染，首先进行的检查是
A. CT
B. B超
C. X线
D. 血常规
E. 尿常规

正确答案：B。B超

解析：无痛性进行性皮肤巩膜黄染为胆管癌、壶腹癌的典型临床表现。由于胆总管下端梗阻，可有肝脏肿大，胆囊充盈肿大。由于为肿瘤压迫胆总管所致，故无感染及Murphy征。为明确胆管癌、壶腹癌的诊断，首先B超（B对）检查。尽管CT（A错）能更清楚的显示胆道梗阻部位、病变性质，但由于价格昂贵不作为首选。X片（C错）、血常规（D错）和尿常规（E错）对胆管癌、壶腹癌的诊断意义不大。